通过成本效益分析，你认为对冠心病所采取的预防措施中，下列哪一种最好
A. 戒烟（COST/QALY＜180美元）
B. 控制高血压（COST/QALY≤1700美元）
C. 控制血脂水平（COST/QALY≥1700美元）
D. 戒烟和控制高血压
E. 戒烟和控制血脂水平

正确答案：A。戒烟（COST/QALY＜180美元）